血白细胞增多异型淋巴细胞比例常高于10%见于
A. 伤寒
B. 中毒型菌痢
C. 流行性乙型脑炎
D. 急性病毒性肝炎
E. 流行性出血热

正确答案：E。流行性出血热

解析：流行性出血热血常规（1）白细胞计数：第1病日多属正常，第3病日后逐渐升高，可达（15～30）×10⁹/L。少数重症患者可达（50～100）×10⁹/L。（2）白细胞分类：发病早期中性粒细胞增多，核左移，有中毒颗粒。重症患者可见幼稚细胞呈类白血病反应。第4～5病日后，淋巴细胞增多，并出现较多的异型淋巴细胞，异型淋巴细胞比例常高于10%（E对）。由于异型淋巴细胞在其他病毒性疾病时亦可出现，因此不能作为疾病诊断的主要依据。（3）血红蛋白和红细胞：由于血浆外渗，导致血液浓缩，所以从发热后期开始至低血压休克期，血红蛋白和红细胞数升高，可达150g/L和5.0×10¹²/L以上。（4）血小板从第2病日起开始减少，一般在（50～80）×10⁹/L左右，并可见异型血小板。